有机磷杀虫药中毒应用胆碱酯酶复能剂可以缓解的临床表现
A. 大汗淋漓
B. 肌肉颤动
C. 肺水肿
D. 恶心呕吐
E. 心动过缓

正确答案：B。肌肉颤动

解析：有机磷农药进入人体后迅速与胆碱酯酶结合形成稳定的磷酰化胆碱酯酶，失去分解乙酰胆碱的能力，导致一系列毒蕈碱样、烟碱样和中枢神经系统症状。胆碱酯酶复能药能有效减轻N样症状，对骨骼肌痉挛的抑制作用最强，能迅速抑制肌肉颤动（B对），对M样症状和中枢神经系统症状无明显作用。毒蕈碱症状又称M样症状，包括瞳孔缩小、恶心、呕吐（D错）、心率减慢（E错）、大小便失禁、大汗（A错）、流泪、咳嗽、气促、呼吸困难，严重者可出现肺水肿（C错）。烟碱样症状又称N样症状，包括肌肉颤动、全身肌强制性痉挛、血压升高、心律失常等。中枢神经系统症状包括头晕、头痛、烦躁、昏迷等。